男，60岁。突发心悸，气促2小时，咳粉红色泡沫样痰，不能平卧。高血压病史20年，未规律服用降压药。查体：BP180/130mmHg。双肺满布干湿性啰音，心界扩大，心率110次/分，律绝对不齐。对该患者最恰当的治疗组合是
A. 硝酸甘油、毛花苷丙、美托洛尔
B. 硝普钠、地尔硫䓬、呋塞米
C. 硝酸甘油、地尔硫䓬、呋塞米
D. 尼尔地平、毛花苷丙、美托洛尔
E. 硝普钠、毛花苷丙、呋塞米

正确答案：E。硝普钠、毛花苷丙、呋塞米

解析：患者老年男性，突发心悸，气促，咳粉红色泡沫样痰，不能平卧，双肺满布干湿性啰音，心界扩大（急性左心衰竭导致的急性肺水肿的典型表现）。心率110次/分，律绝对不齐，考虑诊断为心房颤动。BP180/130mmHg，且患者有高血压病史20年，故患者目前考虑诊断为3级高血压、心房颤动伴急性左心衰竭。毛花苷丙静脉给药最适合用于有快速心室率的心房颤动并心室扩大伴左心室收缩功能不全者，呋塞米除利尿作用外，还有静脉扩张作用，有利于肺水肿缓解。硝普钠同时直接扩张静脉和动脉，降低前、后负荷，迅速降低血压，可用于各种高血压急症。综上所诉，对该患者最恰当的治疗组合是硝普钠、毛花苷丙、呋塞米（E对）。美托洛尔（AD错）为β受体阻滞剂，严禁用于急性左心衰竭的治疗。地尔硫䓬（BC错）为非二氢吡啶类钙通道阻滞剂，多用于舒张性心力衰竭的治疗。